在牙根形成过程中，上皮根鞘、牙乳头、牙囊由外向内的关系依次为
A. 上皮根鞘、牙乳头、牙囊
B. 牙囊、牙乳头、上皮根鞘
C. 牙乳头、上皮根鞘、牙囊
D. 牙囊，上皮根鞘、牙乳头
E. 上皮根鞘、牙囊、牙乳头

正确答案：D。牙囊，上皮根鞘、牙乳头

解析：当牙冠发育即将完成的时候，牙根开始发育。首先是形成上皮根鞘，上皮根鞘的内侧包绕着牙乳头细胞，上皮根鞘的外面被牙囊包绕。故三者由外向内的关系依次是牙囊、上皮根鞘、牙乳头。掌握“牙体、牙周组织的形成”知识点。